经呼吸道动式染毒的主要优点是
A. 受试化合物保持浓度不变
B. 保证染毒柜内氧和二氧化碳分压不变
C. 温湿度恒定
D. 染毒时间不受染毒柜体积限制
E. 以上都是

正确答案：E。以上都是